患者饱餐后上腹部持续疼痛1天。查体：上腹部压痛反跳痛。应首先考虑的是
A. 急性胃炎
B. 急性胰腺炎
C. 急性肝炎
D. 右肾结石
E. 肝癌

正确答案：B。急性胰腺炎

解析：患者饱餐后上腹部持续疼痛1天查体：上腹部压痛反跳痛应首先考虑的是急性胰腺炎。临床以急性上腹痛及血淀粉酶升高为特点，出现弥散性腹膜炎时则全腹有典型的腹膜刺激征。当胰腺及周围大片坏死、渗出或并发脓肿时，上腹可触及包块（B对）。急性胃炎有上腹部或脐周压痛，肠鸣音亢进（A错）。急性肝炎大多有轻中度肝肿大，质地软，常有触痛或叩击痛，脾可轻度肿大，部分有黄疸（C错）。右肾结石常见的症状有腰腹部绞痛、恶心、呕吐、烦躁不安、腹胀、血尿等。如果合并尿路感染，也可能出现畏寒发热等现象（D错）。早期肝癌常无明显阳性体征或仅类似肝硬化体征。中晚期肝癌通常出现肝脏肿大、黄疸、腹水等体征。此外，合并肝硬化者常有肝掌、蜘蛛痣、男性乳腺增大、下肢水肿等（E错）。